成釉细胞瘤最易好发的部位是
A. 下颌前牙区
B. 上颌后牙区
C. 上颌前牙区
D. 下颌体及下颌角部
E. 下颌骨升支部

正确答案：D。下颌体及下颌角部

解析：成釉细胞瘤多发生于青壮年。以下颌体及下颌角部为常见。掌握“成釉细胞瘤”知识点。